氢氯噻嗪常见的不良反应为低钾血症、低钠血症、高糖血症、高尿酸血症等，故使用时应注意氢氯噻嗪的不良反应，同时也要避免重复用药。含有氢氯噻嗪的中成药有
A. 珍菊降压片
B. 脂降宁片
C. 新癀片
D. 脉君安片
E. 冠通片

正确答案：A、D。珍菊降压片；脉君安片

解析：本题考查的是含西药组分的中成药。含有氢氯噻嗪的中成药有珍菊降压片（A对）与脉君安片（D对）。珍菊降压片：功能降压。用于高血压。含西药成分盐酸可乐定、氢氯噻嗪。脉君安片：功能平肝息风，解肌止痛。用于高血压、头痛眩晕、颈项强痛、失眠心悸、冠心病等。含西药成分氢氯噻嗪。脂降宁片（B错）：功能行气散瘀，活血通络，益精血，降血脂。用于胸痹心痛、眩晕耳鸣、肢体麻木、高脂血症或合并高血压、冠心病、动脉硬化等高脂血症。含西药成分维生素C、氯贝酸铝。新癀片（C错）：功能清热解毒，活血化瘀，消肿止痛。用于热毒瘀血所致的咽喉肿痛、牙痛、痹痛、胁痛、黄疸、无名肿毒。含西药成分吲哚美辛。冠通片（E错）：增加冠状动脉血流量，降低冠状动脉阻力，减少心肌耗氧量，并有降低血压的作用。用于冠状动脉粥样硬化、心肌梗死、心绞痛及高血压等。含西药成分维生素C、异去氧胆酸。